不含有内分泌组织的器官有
A. 胰
B. 胸腺
C. 睾丸
D. 卵巢
E. 下颌下腺

正确答案：E。下颌下腺

解析：内分泌腺包括垂体、甲状腺、甲状旁腺、肾上腺、松果体、胸腺（B对）和生殖腺（CD对）等。内分泌组织以细胞团分散于机体的器官或组织内，如胰内的胰岛（A对）、睾丸内的间质细胞、卵巢内的卵泡和黄体等。下颌下腺（E错，为本题正确答案）分泌的液体为唾液的主要成分，因此属于外分泌腺。